在吸烟与某病关系的研究中，吸烟组的死亡率是5%。不吸烟组的死亡率是2%，吸烟的归因危险度是
A. 2.5
B. 0.4
C. 0.3
D. 0.03
E. 无法计算

正确答案：D。0.03